社会医学最常用的研究方法是
A. 试验研究
B. 调查研究
C. 文献研究
D. 评价研究
E. 社区干预研究

正确答案：B。调查研究